治疗急性牙髓炎时，首选应该考虑的问题是
A. 消炎
B. 消灭致病菌
C. 无痛或尽量减少疼痛
D. 防止感染扩散
E. 保护生活牙髓

正确答案：C。无痛或尽量减少疼痛

解析：本题考查急性牙髓炎治疗的应急处理。急性牙髓炎疼痛剧烈，治疗时首先缓解疼痛这一主要症状，应采取措施使患者无痛或尽量减少患者疼痛（C对），为接下来治疗创造条件。消炎（A错）对剧烈疼痛的急性牙髓炎无明显效果，只有在局麻下开髓引流或切开排脓才能有效地止痛。在疼痛缓解后再进行根管治疗消灭致病菌（B错），急性期治疗容易导致感染扩散。为防止感染扩散（D错）通常在缓解疼痛后，急性炎症的第4～5天脓液形成后切开排脓，防止感染扩散是脓肿形成后考虑的问题，不是首选应该考虑的问题。急性期疼痛症状缓解后，如果是年轻恒牙，为了促进未发育完成的牙根继续发育，应尽量保留活髓（E错）；如果是牙根已发育完成的恒牙，不必保存活髓，应进行彻底的根管治疗。